下列关于口腔颌面部损伤的特点叙述错误的是
A. 偶尔发生窒息
B. 影响进食和口腔卫生
C. 易发生感染
D. 易并发颅脑损伤
E. 有时伴有颈部伤

正确答案：A。偶尔发生窒息

解析：口腔颌面部损伤的特点：①口腔颌面部血运丰富在损伤时的利弊；②牙损伤时的利与弊；③易并发颅脑损伤；④有时伴有颈部伤；⑤易发生窒息；⑥影响进食和口腔卫生；⑦易发生感染；⑧易伴其他解剖结构的损伤；⑨面部畸形。掌握“口腔颌面部创伤概论”知识点。